博来霉素引起的不良反应是
A. 膀胱炎
B. 肺毒性
C. 耳毒性
D. 心脏毒性
E. 惊厥

正确答案：B。肺毒性

解析：本题考查博来霉素的不良反应。博来霉素引起的不良反应是肺毒性（B对）。博来霉素骨髓抑制和胃肠道反应均较轻；肺毒性是本品最严重的毒性，可出现间质性肺炎和肺纤维化。